通过抑制Ca²⁺内流，对变异性心绞痛宜选择的药物是
A. 硝酸甘油
B. 硝苯地平
C. 普萘洛尔
D. 胍乙啶
E. 洛伐他汀

正确答案：B。硝苯地平

解析：本题考查硝苯地平。硝苯地平（B对）能抑制心肌对钙离子的摄取，降低心肌兴奋-收缩偶联中ATP酶的活性，使心肌收缩力减弱，耗氧量降低，冠脉扩张，从而缓解变异型心绞痛。硝酸甘油（A错）在体内释放NO血管扩张因子，产生扩血管作用，可用于心绞痛急性发作。普萘洛尔（C错）为非选择性β受体阻断剂，竞争性阻断β₁和β₂受体，进而导致对糖、脂代谢和肺功能的不良影响；阻断血管上的β₂受体，相对兴奋α受体，增加周围动脉的血管阻力，不宜用于变异型心绞痛。胍乙啶（D错）是作用于肾上腺素能神经末梢的抗高血压药。洛伐他汀（E错）为调血脂药，在体内竞争性的抑制胆固醇合成过程中的限速酶，使胆固醇合成减少，低密度脂蛋白受体合成增加。